下列哪个器官不与胃后壁毗邻
A. 横结肠
B. 胰
C. 左肾
D. 脾
E. 无

正确答案：D。脾

解析：横结肠(A对)、胰(B对)、左肾(C对)上部与胃的后壁相邻，而脾(D错，为本题正确答案)与胃底相邻。